以下不属于眶下神经阻滞麻醉区域的是
A. 下眼睑
B. 鼻眶下区
C. 上唇部
D. 磨牙区
E. 上颌前牙

正确答案：D。磨牙区

解析：眶下神经阻滞麻醉区域及效果：麻药注入眶下管内的麻醉效果较眶下孔注射为好，麻醉区域亦较广泛。可以麻醉同侧下眼睑、鼻眶下区、上唇、上颌前牙、前磨牙，以及这些牙的唇颊侧牙槽突、骨膜、牙龈和黏膜等组织。掌握“颌面部常用局麻法及牙拔除的麻醉选择”知识点。